引起颞下颌关节内强直的炎症病变中最常见的是
A. 类风湿性关节炎
B. 化脓性中耳炎
C. 下颌骨骨髓炎
D. 血源性化脓性关节炎
E. 坏疽性口炎

正确答案：B。化脓性中耳炎

解析：关节内强直多发生于15岁以前的儿童。炎症、关节损伤是常见原因，炎症中以化脓性中耳炎最常见。掌握“颞下颌关节强直”知识点。